影响血药浓度的生活因素包括
A. 饮食习惯
B. 食物组成
C. 吸烟、嗜酒
D. 饮茶和咖啡
E. 空气污染

正确答案：A、B、C、D。饮食习惯；食物组成；吸烟、嗜酒；饮茶和咖啡